白细胞减少症的诊断标准是指外周血白细胞总数低于
A. 0.2×10⁹
B. 0.5×10⁹
C. 4.0×10⁹
D. 1.5×10⁹
E. 3.0×10⁹

正确答案：C。4.0×10⁹

解析：白细胞减少症的诊断标准是指外周血白细胞总数低于4.0×10⁹/L（C对）。